军团菌感染的主要途径是
A. 消化道
B. 皮肤
C. 血液
D. 人-人
E. 呼吸道

正确答案：E。呼吸道

解析：本题考查军团菌感染的主要途径。军团菌为需氧革兰阴性杆菌，是一种人类单核细胞和巨噬细胞内寄生菌。军团菌感染的主要途径是呼吸道（E对ABCD错），人通过呼吸道吸入被军团菌污染的气溶胶，使军团菌有机会侵染肺泡组织和肺巨噬细胞，引起严重的肺部感染，导致军团病的发生。